氨基苷类抗生素的不良反应是
A. 再生障碍性贫血
B. 耳蜗听神经损伤
C. 肝毒性
D. 心脏毒性
E. 消化道反应

正确答案：B。耳蜗听神经损伤